六淫邪气中只有外感而无内生的邪气是
A. 风
B. 湿
C. 寒
D. 暑
E. 火

正确答案：D。暑

解析：本题考察六淫邪气与内生五邪的区别。脏腑阴阳失调和气血津液等生理功能异常，可以产生内风、内寒、内湿、内燥、内火的病机变化，但是机体不会内生暑邪，暑邪是自然界在夏至以后，立秋之前由盛夏火热之气所化（D对）。